男，49岁。4小时前突然出现胸骨后闷痛，呈持续性。ECG示：Ⅱ、Ⅲ、aVF导联ST段弓背向上抬高0.2mV。最可能的诊断是
A. 变异型心绞痛
B. 急性心包炎
C. 急性心肌梗死
D. 急性肺动脉栓塞
E. 主动脉夹层分离

正确答案：C。急性心肌梗死

解析：患者中老年男性，突发持续性胸骨后闷痛，心电图显示ST段弓背向上型抬高（急性ST段抬高型心肌梗死特征性改变），故该患者最可能的诊断是急性心肌梗死（C对）。变异型心绞痛（A错）患者也会出现一过性的ST段抬高，但胸痛症状多为数十分钟，持续胸痛达4小时者少见。急性心包炎（P302）（B错）的心电图主要表现为除aVR和V₁导联以外的所有常规导联可能出现ST段呈弓背向下（不是弓背向上）型抬高，aVR和V₁导联ST段压低。急性肺动脉栓塞（D错）一般起病突然，患者突然发生不明原因的面色苍白，出冷汗，呼吸困难，胸痛，咳嗽等症状，甚至晕厥，咳血。主动脉夹层分离（P324）（E错）临床特点为急性起病，突发剧烈的胸背部撕裂样疼痛，多数患者同时伴有难以控制的高血压，一般无特异性ST-T改变。